固定义齿修复的最佳时间一般是
A. 拔牙后3周
B. 拔牙后4周
C. 拔牙后6周
D. 拔牙后2个月
E. 拔牙后3个月

正确答案：E。拔牙后3个月

解析：本题考查固定义齿修复的最佳时间。固定义齿修复的最佳时间一般是拔牙后3个月（E对），此时，创面愈合良好，牙槽嵴吸收趋于稳定，可以进行修复治疗。牙槽嵴的吸收一般在牙缺失后头3个月最快，若拔牙后时间过短，不足3个月（ABCD错），在牙槽嵴吸收活动期时行固定义齿修复，则容易出现牙槽嵴吸收加剧，义齿修复后出现邻牙活动，桥体与牙槽嵴距离过大，容易积存食物，并发牙龈炎等不利影响。